属于牙膏防腐剂的是
A. 二氧化硅
B. 月桂醇硫酸钠
C. 丙三醇
D. 羧甲基纤维素钠
E. 乙醇

正确答案：E。乙醇

解析：本题考查牙膏中防腐剂的相关知识点。乙醇（E对）为常用的牙膏防腐剂之一。二氧化硅（A对）为牙膏中摩擦剂的成分。月桂醇硫酸钠（B错）为牙膏中的洁净剂。丙三醇（C错）为牙膏中的保湿剂。羧甲基纤维素钠（D错）为牙膏中的胶粘剂。